克拉霉素
A. 含青霉烷砜结构的药物
B. 含青霉烷结构的药物
C. 含碳青霉烯结构的药物
D. 含并四苯结构的药物
E. 含内酯环结构的药物

正确答案：E。含内酯环结构的药物

解析：本题考查克拉霉素。克拉霉素属于大环内酯类抗菌药，分子中含有14元内酯环结构（E对）。含青霉烷砜结构（A错）的为青霉烷砜类，代表药物舒巴坦。含青霉烷结构（B错）的为氧青霉烷类，代表药物克拉维酸。含碳青霉烯结构（C错）的为碳青霉烯类，代表药物亚胺培南。含并四苯结构（D错）的为四环素类，代表药物四环素。